心理治疗应遵循的道德要求
A. 掌握和运用心理治疗的知识、技巧去开导患者
B. 要用焦虑、热切的心态去影响患者
C. 医务人员必须把自己的情感加在解决患者问题中
D. 医疗情况下患者的秘密和隐私权无须保护
E. 无须回答患者问题

正确答案：A。掌握和运用心理治疗的知识、技巧去开导患者